下列各项，不属于子痰溃后症状的是
A. 脓液清稀如痰涎
B. 脓液中夹有败絮状物
C. 疮口凹陷
D. 容易形成瘘管
E. 疮口容易愈合

正确答案：E。疮口容易愈合

解析：子痰溃破后脓液清稀如痰（A错）。脓液中可夹有败絮（豆腐渣）样物质（B错）。疮口是由慢性硬结逐渐增大，形成脓肿，溃后所致，故疮口凹陷（C错）。子痰易形成窦道（D错），并且经久不愈（E对）。